急性淋巴细胞白血病
A. 过氧化酶强阳性
B. 中性粒细胞碱性磷酸酶偏低
C. 非特异酯酶染色阳性，可被氟化钠抑制
D. 细胞内铁染色强阳性
E. 糖原染色阳性，呈块状或颗粒状

正确答案：E。糖原染色阳性，呈块状或颗粒状

解析：急性淋巴细胞白血病细胞化学染色的特点是糖原染色阳性，呈块状或颗粒状（E对）。髓过氧化酶强阳性（A错）主要见于急性粒细胞白血病、急性早幼粒细胞白血病；中性粒细胞碱性磷酸酶偏低（B错）主要见于急、慢性粒细胞白血病、恶性组织细胞病等；非特异酯酶染色阳性，可被氟化钠抑制（C错）主要见于急性单核细胞白血病；细胞内铁染色强阳性（D错）主要见于铁粒幼细胞性贫血。